治疗蛔虫引起的蛔厥腹痛呕吐，肺虚久咳，宜首选
A. 槟榔
B. 花椒
C. 乌梅
D. 使君子
E. 苦楝皮

正确答案：C。乌梅

解析：乌梅味酸而涩，其性收敛，入肺经能敛肺气止咳嗽，治疗肺虚久咳少痰；乌梅极酸，具有安蛔止痛，和胃止呕的功效，为安蛔之良药，治疗蛔厥腹痛呕吐（C对）。槟榔（A错）对绦虫、蛔虫、蛲虫、钩虫、姜片虫等肠道寄生虫都有驱杀作用，并以泻下作用驱除虫体为其优点。花椒（B错）辛散温燥，入脾胃经，用于治疗脘腹冷痛，呕吐泄泻，虫积腹痛。使君子（D错）味甘气香而不苦，性温入脾胃经，有良好的杀虫作用，主要应用于蛔虫病，蛲虫病，虫积腹痛，小儿疳积。苦楝皮（E错）苦寒有毒，有较强的杀虫作用，主要应用于蛔虫病，蛲虫病，虫积腹痛，疥癣瘙痒。